下列描述不是食物中毒发病特点的是
A. 发病潜伏期短，来势急剧，呈暴发性
B. 中毒病人都具有消化道症状，伴高热、失水及休克
C. 发病与食物有关，病人有食用同一污染食物史
D. 中毒病人一般具有相同或相似的临床表现
E. 中毒病人对健康人不具传染性

正确答案：B。中毒病人都具有消化道症状，伴高热、失水及休克